服药后尿、唾液、汗液、痰液、泪液等排泄物均可显橘红色的药物是
A. 乙胺丁醇
B. 吡嗪酰胺
C. 利福平
D. 链霉素
E. 异烟肼

正确答案：C。利福平

解析：本题考查利福平。服药后尿、唾液、汗液、痰液、泪液等排泄物均可显橘红色的药物是利福平（C对）。利福平及其代谢产物均呈橘红色，服药过程中可使痰、尿、唾液、汗液及粪红染，应事先告知服药者。